50岁女性，孕5产5，绝经3年，阴道不规则流血1月。妇科检查：外阴阴道正常，宫颈肥大糜烂触之易出血，子宫后屈稍小，双侧附件未见异常。若以上检查未发现可疑病灶，下一步最恰当的处理是
A. 分段刮宫
B. 子宫镜+子宫内膜活检
C. 宫颈激光
D. 宫颈锥切术
E. 3～6个月后复查

正确答案：A。分段刮宫

解析：患者为中老年妇女，绝经后出现阴道不规则流血（宫颈癌老年患者常为绝经后不规则阴道流血）。妇检：外阴阴道正常，宫颈肥大糜烂触之易出血（接触性出血），子宫后屈稍小，双侧附件未见异常，首先考虑为宫颈癌。因宫颈活组织检查未发现可疑病灶，应怀疑为子宫内膜癌或内生型子宫颈癌，下一步最恰当的处理是行分段刮宫（A对）。分段刮宫是确诊子宫内膜癌的首选检查，可以用来区分子宫内膜癌和内生型子宫颈癌。子宫镜+子宫内膜活检（B错）主要用于宫腔内膜病变的诊断，价格昂贵，非首选。宫颈激光是治疗慢性宫颈炎效果较好、疗程最短的方法（C错），可将宫颈糜烂面上皮破坏，使之坏死脱落后被新生的鳞状上皮覆盖。宫颈锥切术（D错）主要适用于宫颈涂片多次阳性而宫颈活检阴性者。